预防运动中牙外伤的
A. 服维生素C
B. 饭后刷牙
C. 窝沟封闭
D. 护牙托
E. 用吸管饮用饮料

正确答案：D。护牙托

解析：本题考查牙外伤的预防。预防运动中牙外伤的是护牙托（D对）。护牙托是一种弹性片状减震装置，多用乙烯酸乙烯共聚物制作而成。护牙托的作用是：1.保护牙齿和口内其他组织，如牙龈、颊和唇；2.防止领骨骨折，特别是保护颞下颌关节；3.预防外力对颅脑的冲击伤害，降低脑震荡发生的可能；4.增强运动员的安全感。护牙托还可以根据不同的防护类型适当调整厚度，提高舒适度，但前牙区唇侧牙托厚度需达3～4mm，第一磨牙区颊侧及咬合面的厚度至少达2～3mm。服维生素C（A错）可预防坏血病、传染病、紫癜等。饭后刷牙（B错）会刮掉牙釉质、帮助酸性物质扩散、出现牙本质过敏症，对牙齿健康不利。窝沟封闭（C错）可增强牙对龋病抵抗力。用吸管饮用（E错）可减少酸性饮料接触牙面的时间，预防酸蚀症。